下列哪种情形属于预防接种异常反应
A. 因疫苗本身特性引起的接种后一般反应
B. 合格的疫苗在实施规范接种后造成受种者功能损害，相关各方均无过错的药品不良反应
C. 因疫苗质量不合格给受种者造成的损害
D. 受种者在接种时正处于某种疾病的潜伏期，接种后偶合发病
E. 因心理因素发生的个体或者群体的心因性反应

正确答案：B。合格的疫苗在实施规范接种后造成受种者功能损害，相关各方均无过错的药品不良反应